以强制参保为原则，参保范围涵盖城镇所有用人单位和职工的保险为
A. 城镇职工基本医疗保险
B. 补充医疗保险
C. 城镇居民基本医疗保险
D. 社会医疗保险
E. 商业医疗保险

正确答案：A。城镇职工基本医疗保险

解析：本题考查中国的多层次医疗保障体系-城镇职工基本医疗保险。以强制参保为原则，参保范围涵盖城镇所有用人单位和职工的保险为城镇职工基本医疗保险（A对）。补充医疗保险（B错）是由单位、企业或特定人群，根据自己的经济承担能力，在基本医疗保险制度基础上自愿参加的各种辅助性的医疗保险。城镇居民基本医疗保险（C错）的参保范围为不属于城镇职工基本医疗保险制度覆盖范围的中小学阶段的学生（包括职业高中、中专、技校学生）、少年儿童、在校大学生和其他非从业城镇居民，符合条件的灵活就业人员、农民工等流动就业人员可以选择参加城镇居民医疗保险；城镇居民医疗保险属于自愿参加，保险费以家庭交费为主，政府给予适当补贴。社会医疗保险（D错）是国家通过立法强制建立实施的一种社会保险制度，医疗保险金来源主要是由雇主和雇员按一定比例缴纳，政府适当补贴。商业医疗保险（E错）是由商业保险公司开办，以营利为目的，参保人员自愿参加的一种医疗保险制度。